2岁女童，低热1月，消瘦，乏力，颈淋巴结肿大，肺无啰音，出生接种过卡介苗，PPD（+++），胸片示肺门淋巴结肿大，最可能的诊断是
A. 何杰金氏病
B. 原发综合症
C. 支气管淋巴结结核
D. 支原体肺炎
E. 传染性单核细胞增多症

正确答案：C。支气管淋巴结结核

解析：何杰金氏病通常是肝脾肿大、纵隔淋巴结肿大，而不是肺门淋巴结肿大（A错）。原发综合症（P192）主要为肺内病灶，胸片说肺内无病灶，不称为综合症（B错）。该患儿临床症状低热1月，消瘦乏力，颈部淋巴结肿大，接种过卡介苗，PPD实验强阳性，表明体内有活动性结核病，有根据胸片显示肺门淋巴节肿大，即可判定为支气管淋巴节结核（C对）。 支原体肺炎（P261）时通常无淋巴结肿大（D错）。传染性单核细胞增多症（P176）时需要看血常规是否异常才可诊断（E错）。